患者，女，20岁，未婚。发现下腹部肿块1年，突发下腹部疼痛伴恶心呕吐6小时。肛查：子宫前位，大小正常，左侧盆腔扪及7cm×8cm×8cm肿块，边界清楚，压痛明显。首先应考虑的诊断是
A. 卵巢肿瘤出血
B. 卵巢肿瘤蒂扭转
C. 卵巢肿瘤破裂
D. 卵巢巧克力囊肿破裂
E. 卵巢肿瘤变性

正确答案：B。卵巢肿瘤蒂扭转

解析：瘤蒂由骨盆漏斗韧带、卵巢固有韧带和输卵管组成，急性扭转后，静脉回流受阻，瘤内高度充血或血管破裂致使瘤体急剧增大，肿瘤发生坏死变为紫黑色，易发生破裂和继发感染。本题患者因现下腹部肿块1年，突发下腹部疼痛伴恶心呕吐，左侧盆腔扪及7cm×8cm×8cm肿块，边界清楚，压痛明显，可诊断为卵巢肿瘤蒂扭转（B对）；卵巢肿瘤出血颜色为鲜红色，并伴随腹痛等症状（A错）；小囊肿或单纯性浆液性囊腺瘤破裂时，仅感轻度腹痛；大囊肿或成熟畸胎瘤破裂后，常致剧烈腹痛伴恶心呕吐，有时可导致腹腔内出血、腹膜炎及休克。妇科检查腹部压痛、肌紧张或有腹水征，原有肿块消失（C错）；卵巢巧克力囊肿破裂是指卵巢巧克力囊肿因多种因素而发生自发或在外力影响下的破裂，破裂可反复发生。破裂后陈旧性血液溢入腹腔，引起剧烈腹痛、恶心呕吐等（D错）；卵巢良性肿瘤若生长迅速，尤其为双侧性，应疑有恶变（E错）。